恶性肿瘤引起发热的原因是
A. 淋巴因子
B. 内毒素
C. 抗原抗体复合物
D. 内生致热原
E. 本胆烷醇酮

正确答案：D。内生致热原

解析：肿瘤细胞作为产EP细胞，可以产生和释放内生致热原（D对），从而引起发热。淋巴因子（A错）、内毒素（B错）、抗原抗体复合物（C错）、本胆烷醇酮（E错）属于发热激活物。